表示疾病流行强度的术语包括
A. 季节性、周期性、流行、大流行
B. 流行、暴发、季节性、散发
C. 散发、暴发、流行、大流行
D. 季节性、流行、暴发、长期变动
E. 暴发、流行、大流行、长期变动

正确答案：C。散发、暴发、流行、大流行